花鹿茸侧枝一个者习称
A. 莲花
B. 二杠
C. 门庄
D. 单门
E. 三岔

正确答案：B。二杠

解析：本题考查的是鹿茸药材的性状鉴别。花鹿茸侧枝一个者习称二杠（B对）。花鹿茸：：【性状鉴别】呈圆柱状分枝，具1个分枝者习称“二杠”，主枝习称“大挺”，离锯口约1cm处分出侧枝，习称“门庄（C错）”。具两个分枝者，习称“三岔（E错）”。莲花（A错）与单门（D错）为马鹿茸的鉴别术语。马鹿茸：：【性状鉴别】较花鹿茸粗大，分枝较多，侧枝1个者习称“单门”，2个者习称“莲花”，3个者习称“三岔”，4个者习称“四岔”或更多。